下列关于副神经的叙述正确的是
A. 自胸锁乳突肌中点入该肌
B. 与迷走神经没关系
C. 支配胸锁乳突肌等
D. 支配背阔肌
E. 经枕骨大孔出颅

正确答案：C。支配胸锁乳突肌等

解析：副神经的延髓根起自疑核，加入迷走神经（B错），支配咽喉肌。脊髓根出脊髓后在椎管内上行，经枕骨大孔入颅，与延髓根合成副神经一起经颈静脉孔出颅（E错），脊髓根行至胸锁乳突肌深面（A错），分出一支支配胸锁乳突肌，从胸锁乳突肌穿出后于斜方肌前缘中、下1/3交点处进入其深面并分支支配该肌（C对）。背阔肌由胸背神经支配（D错）。